急性心肌梗死，其闭塞的冠状动脉最常见的是
A. 左冠状动脉回旋支
B. 右冠状动脉
C. 左冠状动脉主干
D. 右冠状动脉加左冠状动脉回旋支
E. 左冠状动脉前降支

正确答案：E。左冠状动脉前降支

解析：心肌梗死（MI）最常见的类型是透壁性MI，约占50%，此型最常闭塞的冠状动脉是左冠状动脉前降支（E对）。左冠状动脉回旋支及右冠状动脉闭塞也可见于急性心肌梗死中，但均较少见。